关于药品定价，说法正确的是
A. 全部放开，由市场调节
B. 全部由国家定价
C. 省级价格主管部门不负责药品定价
D. 国家制定药品出厂价、批发价及零售价
E. 由政府价格主管部门制定最高零售价

正确答案：E。由政府价格主管部门制定最高零售价

解析：本题考查药品定价。政府定价由国家价格主管部门制定最高零售价（E对）。我国的药品价格管理经历了从国家计划统一定价，到市场调节经营者自主定价，再到政府定价和市场调节价相结合，以及当前执行的取消绝大部分药品政府定价四个阶段。其中政府定价由国家价格主管部门制定最高零售价，政府指导价由国家价格主管部门制定基准及浮动幅度后由省级价格主管部门制定（C错），市场调节价由企业自主定价。